球结膜水肿见于
A. 肝炎
B. 颅内高压
C. 沙眼
D. 高血压不伴颅内高压
E. 急性肾小球肾炎

正确答案：B。颅内高压

解析：结膜分为睑结膜、穹结膜和球结膜三部分，球结膜透明而隆起为球结膜水肿，见于脑水肿、颅内高压（B对D错）或输液过多。肝炎（A错）时，发生黄疸，结膜发黄。沙眼（C错）沙眼是由沙眼衣原体引起的一种慢性传染性结膜角膜炎，因其在睑结膜表面形成粗糙不平的外观，形似沙粒，本病病变过程早期结膜有浸润，如乳头、滤泡增生，同时发生角膜血管翳；晚期由于受累的睑结膜发生瘢痕，以致眼睑内翻畸形，加重角膜的损害，可严重影响视力甚至造成失明。急性肾小球肾炎（E错）结膜一般无改变。